根据处方管理办法，关于处方书写规则的说法错误的是
A. 药品名称应当使用规范的中文，英文，或拉丁文名称书写
B. 书写的药品名称，剂量规格用法用量要准确规范
C. 药品用法，可用规范的中文英文拉丁文和缩写体书写
D. 医疗机构或医师药师不得自行编制药品缩写名称或者使用代号

正确答案：A。药品名称应当使用规范的中文，英文，或拉丁文名称书写

解析：本题考查的是处方书写。药品名称应当使用规范的中文名称书写，没有中文名称的可以使用规范的英文名称书写（A错，为本题正确答案）。处方书写：处方书写应当符合的规则列举如下：患者一般情况、临床诊断填写清晰、完整，并与病历记载相一致；每张处方限于一名患者的用药。字迹清楚，不得涂改；如需修改，应当在修改处签名并注明修改日期；药品名称应当使用规范的中文名称书写，没有中文名称的可以使用规范的英文名称书写；医疗机构或者医师、药师不得自行编制药品缩写名称或者使用代号（D错）；书写药品名称、剂量、规格、用法、用量要准确规范（B错），药品用法可用规范的中文、英文、拉丁文或者缩写体书写（C错），但不得使用“遵医嘱”“自用”等含糊不清字句；药品用法用量应当按照药品说明书规定的常规用法用量使用，特殊情况需要超剂量使用时，应当注明原因并再次签名；处方医师的签名式样和专用签章应当与院内药学部门留样备查的式样相一致，不得任意改动，否则应当重新登记留样备案。